患者，男，55岁，全身水肿，按之没指，小便短少，身体困重，胸闷，纳呆，恶心，舌苔白腻，脉沉缓。治疗方法是
A. 宣肺解毒，利湿消肿
B. 清热利湿消肿
C. 健脾利湿，通阳利水
D. 散风清热，宣肺行水
E. 滋阴清热利水

正确答案：C。健脾利湿，通阳利水

解析：水湿之邪，浸渍肌肤，壅滞不行，以致全身水肿，按之没指；水湿内聚，以致三焦决渎失司，膀胱气化失常导致小便短少；脾为湿困，阳气不得舒展而见身体困重，胸闷，纳呆，恶心；舌苔白腻，脉沉缓，均为水湿浸渍证之侯，治疗需健脾化湿，通阳利水（C对）。宣肺解毒，利湿消肿（A错）治疗湿毒浸淫证。清热利湿消肿（B错）治疗湿热壅盛证。散风清热，宣肺行水（D错）用于治疗风水泛滥证。滋阴清热利水（E错）用于治疗阴虚内热证。